氟牙症一般多见于恒牙，原因是
A. 乳牙的成釉细胞对氟的影响有抵抗作用
B. 乳牙矿化程度比恒牙低，因此受氟的影响小
C. 乳牙牙胚发育、生长、矿化时间比恒牙短得多，所以受氟的影响小
D. 乳牙的发育分别在胚胎期和乳婴期，胎盘对氟有一定的屏障作用
E. 以上均是

正确答案：D。乳牙的发育分别在胚胎期和乳婴期，胎盘对氟有一定的屏障作用

解析：本题考查氟牙症一般多见于恒牙的原因。氟牙症多见于恒牙，发生在乳牙者较少，程度也较轻，原因是乳牙的发育分别在胚胎期和婴儿期，而胎盘对氟有一定的屏障作用（D对），胚胎期只有极少量的氟通过胎盘，母乳含氟量也很低且较恒定。乳牙或者恒牙，成釉细胞都是一样的，对氟的反应也是一样的（A错）。氟牙症的发生是因为氟在釉质发育矿化期间进入体内，侵害成釉细胞引起，与矿化程度及牙胚发育、生长、矿化时间无关（BC错）。